桔梗顶端较短的根茎习称
A. 蚯蚓头
B. 芦头
C. 狮子盘头
D. 芦碗
E. 金包头

正确答案：B。芦头